以下关于必要病因的正确真实的陈述是
A. 所谓的必要病因一定同相应疾病的分类依据有关
B. 传染病有必要病因（病原体），而非传染病没有必要病因
C. 如果要预防疾病，一定需要去除必要病因
D. 吸烟是肺癌的必要病因
E. 必要病因是病因研究中的重要部分

正确答案：A。所谓的必要病因一定同相应疾病的分类依据有关

解析：本题考查必要病因。所谓的必要病因一定同相应疾病的分类依据有关（A对BCDE错），必要病因是一个疾病发生必需的组分病因，是该疾病所有充分病因都需要的组分病因。